“同病异治”的“同病”是指
A. 病因相同
B. 病种相同
C. 病证相同
D. 病机相同
E. 症状相同

正确答案：B。病种相同

解析：本题考查的是同病异治的概念。“同病异治”的“同病”是指病种相同（B对）。“同病异治”与“异病同治”：中医学认为，同一种疾病可以包括几种不同的证，不同的疾病在其发展过程中可以出现相同的证（C错），因此，在临床治疗中往往采取“同病异治”或“异病同治”的方法。“同病异治”，是指同一种疾病，由于发病的时间、地区及患者机体的反应不同，或处于不同的发展阶段，所表现的证不同，因而治法就各异。“异病同治”，则是指不同的疾病，在其发展过程中，由于出现了相同的病机（D错），因而也可以采用同一种方法来治疗。由此可见，中医治病主要不是着眼于“病”的异同，而是着眼于“证”的区别。所谓“证同治亦同，证异治亦异”，即是“同病异治”或“异病同治”的依据。病因相同（A错），是指引起人体疾病的原因相同。病因，即指引起人体疾病的原因，又称致病因素、病邪。在中医病因学中六淫是最主要的发病因素之一。症状相同（E错），是指疾病的外在表现相同。症，指疾病的外在表现，即症状。